患者脑脊液检查结果：蛋白质定性（+++），定量10g/L氯化物为100mmol/L，葡萄糖为2.0mmol/L，可能的诊断是
A. 流行性乙型脑炎
B. 化脓性脑膜炎
C. 病毒性脑膜炎
D. 脑膜白血病
E. 结核性脑膜炎

正确答案：B。化脓性脑膜炎

解析：化脓性脑脊髓膜炎时蛋白质总量高度增高，由于胶体渗透压的增高，影响血中氯化物渗入脑脊液，故使脑脊液中氯化物含量降低，同时葡萄糖定量试验降低主要见于化脓性脑膜炎、结核性脑膜炎等（B对）。流行性乙型脑炎脑脊液呈无色透明，压力仅轻度增高，白细胞计数增加。糖正常或偏高，蛋白质常轻度增高，氯化物正常（A错）。病毒性脑膜炎脑脊液无色透明，压力正常或增高，细胞数轻度增加，糖和氯化物含量正常，蛋白略升高（C错）。脑膜白血病见脑脊液压力增高，颅神经受损，可出现视力障碍及面神经麻痹等（D错）。结核性脑膜炎可见脑脊液压力增高，外观无色透明或微黄，静置后可有薄膜形成；淋巴细胞显著增多，蛋白增高，糖及氯化物下降，脑脊液涂片抗酸染色可见结核菌（E错）。